属于抗凝药物的是
A. 尿激酶
B. 阿司匹林
C. 双嘧达莫
D. 低分子量肝素
E. 组织型纤溶酶原激活剂

正确答案：D。低分子量肝素

解析：抗凝药是通过影响凝血因子，从而阻止血液凝固过程的药物，临床主要用于血栓栓塞性疾病的预防和治疗。抗凝药可分为凝血酶间接抑制药和凝血酶抑制药，前者包括肝素、低分子肝素（D对）等，后者包括华法林等。尿激酶、组织型纤溶酶原激活剂是纤维蛋白溶解药（AE错）（P267-268），可直接激活纤维蛋白溶酶原使其转变为纤溶酶，发挥溶血栓作用。阿司匹林是抗血小板药（B错）（P270），是环氧酶抑制药，可抑制花生四烯酸转化为PGG2和PGH2，从而使血小板TXA2合成减少，从而发挥抗血小板作用。双嘧达莫也是抗血小板药（C错）（P271），其通过增加血小板内c-AMP而发挥抗血小板作用。